在下列神经纤维中，只含运动纤维的为
A. 脊神经前根
B. 脊神经后根
C. 脊神经前支
D. 脊神经后支
E. 脊神经脊膜返支

正确答案：A。脊神经前根

解析：脊神经前根（A对）由运动性神经根丝构成。脊神经后根由感觉性神经根丝构成。脊神经前支和后支（CD错）均为混合性神经支。脊神经脊膜返支（E错）为内脏运动神经支。